属于酪氨酸激酶抑制剂的靶向抗肿瘤药是
A. 伊马替尼
B. 他莫昔芬
C. 氨鲁米特
D. 氟他胺
E. 紫杉醇

正确答案：A。伊马替尼

解析：本题考查靶向抗肿瘤药。甲磺酸伊马替尼（A对）是第一个上市的酪氨酸激酶抑制剂，其在体内外均可在细胞水平上抑制“费城染色体”的Bcr-Ahl酪氨酸激酶，能选择性抑制Bcr-Ahl阳性细胞系细胞、Ph染色体阳性的慢性粒细胞白血病和急性淋巴细胞白血病病人的新鲜细胞的增殖和诱导其凋亡。他莫昔芬（B错）为合成的抗雌激素药物。结构类似雌激素，能与雌二醇竞争雌激素受体，与雌激素受体形成稳定的复合物，并转运入核内，阻止染色体基因开放，从而使癌细胞的生长和发育受到抑制。氨鲁米特（C错）在外周组织中，通过阻断芳香化酶而抑制雌激素的生成，从而减少雌激素对乳腺癌的促进作用，起到抑制肿瘤生长的效果。氟他胺（D错）抗雄性激素类药物,临床上常用于治疗前列腺癌或者良性前列腺肥大。紫杉醇（E错）为有丝分裂抑制剂的抗肿瘤药。